急性心肌梗死引起的室性心律失常的首选药是
A. 利多卡因
B. 阿托品
C. 苯妥英钠
D. 维拉帕米
E. 普萘洛尔

正确答案：A。利多卡因

解析：利多卡因是治疗急性心肌梗死引起的室性心律失常的首选药（A对）。妥英纳主要用于治疗室性心律失常，特别对强心苷中毒引起的室性心律失常有效（C错）。阿托品用于治疗迷走神经过度兴奋所致窦房阻滞、房室阻滞等缓慢型心律失常（B错）。维拉帕米治疗室上性和房室结折返引起的心律失常效果好，为阵发性室上性心动过速治疗的首选药（D错）。普萘洛尔适用于治疗与交感神经兴奋有关的各种心律失常。主要用于室上性心律失常（E错）。